导致青霉素过敏的致病因素属于
A. 生物性因素
B. 免疫性因索
C. 先天性因素
D. 药物性因素
E. 理化性因索

正确答案：B。免疫性因索

解析：导致青霉素过敏的致病因素属于免疫性因素（B对）。